循行于腹中线旁开2寸，胸中线旁开4寸的经脉是
A. 手太阴肺经
B. 足阳明胃经
C. 足少阴肾经
D. 足太阴脾经
E. 足厥阴肝经

正确答案：B。足阳明胃经

解析：该题考查十二经脉在躯干部的分布规律。循行与腹胸面的经脉，正中线为任脉，自内向外依次为足少阴肾经（距正中线在腹部为0.5寸，在胸部为2寸）（C错）、足阳明胃经（距正中线在胸部为4寸，经过乳头，在腹部为2寸）（B对）、足太阴脾经（距正中线在腹部为4寸，在胸部为6寸）（D错）和足厥阴肝经（在胁肋部和胸外侧部）（E错）。手太阴肺经从胸部行与腋下（A错）。记忆：在胸腹部由内向外依次是，任肾胃脾肝，趣记，人身为皮干。